碳酸锂主要用于治疗
A. 躁狂症
B. 抑郁症
C. 精神分裂
D. 呕吐
E. 意识淡薄

正确答案：A。躁狂症

解析：锂盐对躁狂症患者有显著疗效，特别是对急性躁狂和轻度躁狂疗效显著。掌握“丙米嗪、碳酸锂、氟西汀”知识点。